女，45岁。不慎被汽车撞伤左下肢。查体：左膝部小腿淤血、肿胀、疼痛，膝关节屈伸受限，足背动脉触诊不清，足背曲、外翻功能障碍。其中符合腓总神经损伤的表现是
A. 小腿疼痛、活动受限
B. 足背屈、外翻功能障碍
C. 小腿淤血、肿胀
D. 足背动脉触不清
E. 膝关节屈伸受限

正确答案：B。足背屈、外翻功能障碍

解析：腓总神经于腘窝沿股二头肌内缘斜向外下，经腓骨长肌两头之间绕腓骨颈，分腓浅、腓深神经。前者于腓骨长、短肌间下行，小腿下1/3穿出深筋膜至足背内侧和中间。后者于趾长伸肌和胫前肌间，贴骨间膜下降，与胫前动静脉伴行，于、趾长伸肌之间至足背。支配小腿前外侧伸肌群及小腿前外侧和足背皮肤。腓骨头、颈部骨折易引起腓总神经损伤，导致小腿前外侧伸肌麻痹，出现踝背伸、外翻功能障碍，呈足内翻下垂畸形。伸、伸趾功能丧失，小腿前外侧和足背前、内侧感觉障碍。故本题符合腓总神经损伤的表现是足背屈外翻功能障碍（B对）。小腿疼痛活动受限（A错）、小腿淤血肿胀（C错）多为骨折后的一般表现。足背动脉触不清（D错）提示可能损伤胫前血管。膝关节屈伸受限（E错）提示可能存在胫骨平台骨折。